国内某医药集团通过不同路径寻求产品的多元化发展，获得国家食品药品监督管理总局批准的氯吡格雷片批准文号X和某抗生素新药批准文号Y，同时获得进口香港某药品生产企业生产的盐酸氨基葡萄糖胶囊的批准文号Z。药品批准文号Y的格式是
A. 国药准字HJ+4位年号+4位顺序号
B. 国药准字HC+4位年号+4位顺序号
C. 国药准字H+4位年号+4位顺序号
D. 国药证字H+4位年号+4位顺序号

正确答案：C。国药准字H+4位年号+4位顺序号

解析：本题考查的是药品批准文件的格式。国内某医药集团通过不同路径寻求产品的多元化发展，获得国家食品药品监督管理总局批准的氯吡格雷片批准文号X和某抗生素新药批准文号Y，同时获得进口香港某药品生产企业生产的盐酸氨基葡萄糖胶囊的批准文号Z。药品批准文号Y的格式是国药准字H+4位年号+4位顺序号（C对）。药品批准文件：药品注册证书载明药品批准文号、持有人、生产企业等信息；属于非处方药的，注明非处方药类别。经核准的药品生产工艺、质量标准、说明书和标签作为附件一并发给申请人，必要时还应附药品上市后研究要求。上述信息纳入药品品种档案，并根据上市后变更情况及时更新。药品注册证书载明的药品批准文号的格式：①境内生产药品：国药准字H（Z、S）+四位年号+四位顺序号；②中国香港、澳门和台湾地区生产药品：国药准字H（Z、S）C+四位年号+四位顺序号（B错）；③境外生产药品：国药准字H（Z、S）J+四位年号+四位顺序号（A错）。其中，H代表化学药，Z代表中药，S代表生物制品。药品批准文号，不因上市后的注册事项的变更而改变。药品监督管理部门制作的药品注册批准证明电子文件及原料药批准文件电子文件与纸质文件具有同等法律效力。